对门诊癌症患者开具一类精神药品的每张处方发药量不得超过
A. 三日极量
B. 二日常用量
C. 二日极量
D. 三日常用量
E. 七日常用量

正确答案：D。三日常用量

解析：本题考查处方限量。为门（急）诊癌症疼痛患者和中、重度慢性疼痛患者开具的麻醉药品、第一类精神药品注射剂，每张处方不得超过3日常用量（D对）；控缓释制剂，每张处方不得超过15日常用量；其他剂型，每张处方不得超过7日常用量（E错）。为门（急）诊一般患者开具的麻醉药品注射剂，每张处方为一次常用量；控缓释制剂，每张处方不得超过7日常用量；其他剂型，每张处方不得超过3日常用量。第一类精神药品处方限量同麻醉药品；哌醋甲酯用于治疗儿童多动症时，每张处方不得超过15日常用量。第二类精神药品一般每张处方不得超过7日常用量；对于慢性病或某些特殊情况的患者，处方用量可以适当延长，医师应当注明理由。